不入煎剂，只入丸散的药物是
A. 使君子
B. 槟榔
C. 鹤草芽
D. 雷丸
E. 南瓜子

正确答案：D。雷丸

解析：雷丸的用法是不宜入煎剂入丸、散（D对）。使君子的用法是即可入煎剂又可入丸散（A错）。槟榔只可入煎剂而不能入丸散（B错）。鹤草芽的用法是研末吞服（C错）。南瓜子的用法是研粉服用（E错）。